胚胎期形成免疫耐受的原因是
A. 免疫系统尚未发育成熟
B. 免疫系统处于免疫抑制状态
C. 免疫系统处于异常活跃状态
D. 从母体获得了IgG类抗体
E. 从母体获得了IgA类抗体

正确答案：D。从母体获得了IgG类抗体